初孕妇，32岁。妊娠20周，合并子宫肌壁间肌瘤，剧烈腹痛1天，无阴道流血。查体：T38.2℃，血常规：WBC10×10⁹/L，N0.75，最可能的诊断是
A. 子宫肌瘤囊性变
B. 子宫肌瘤蒂扭转
C. 子宫肌瘤合并急性阑尾炎
D. 子宫肌瘤合并感染
E. 子宫肌瘤红色样变

正确答案：E。子宫肌瘤红色样变

解析：该患者为初孕妇，32岁，妊娠20周（红色样变多见于妊娠期或产褥期），合并子宫肌壁间肌瘤，剧烈腹痛1天，无阴道流血，查体：T38.2℃，血常规：WBC10×10⁹/L，N0.75（患者可有剧烈腹痛伴恶心、呕吐、发热，白细胞计数升高），最可能的诊断是子宫肌瘤红色样变（E对）。子宫肌瘤囊性变（P311）（A错）是由玻璃样变继续发展而来的，无特异性临床表现。子宫肌瘤蒂扭转（B错）多见于浆膜下肌瘤，可有急性腹痛，而该患者为肌壁间肌瘤。子宫肌瘤合并急性阑尾炎（P098）（C错）表现为压痛点在右下腹，但压痛点位置常偏高，WBC＞15×10⁹/L有助于诊断。子宫肌瘤合并感染（P311）（D错）表现为不规则阴道流血或脓性白带。